根据《中华人民共和国药品管理法》，属于劣药的是
A. 变质的药品
B. 被污染的药品
C. 所标明适应症或者功能主治超出规定范围的药品
D. 未注明生产批号的药品
E. 所含成分与药典规定不符的药品

正确答案：B、D。被污染的药品；未注明生产批号的药品

解析：本题考查劣药的界定。根据《中华人民共和国药品管理法》，属于劣药的是被污染的药品（B对）、未注明生产批号的药品（D对）。劣药的界定：根据《药品管理法》第九十八条第三款规定，有下列情形之一的，为劣药：①药品成分的含量不符合国家药品标准；②被污染的药品；③未标明或者更改有效期的药品；④未注明或者更改产品批号的药品；⑤超过有效期的药品；⑥擅自添加防腐剂、辅料的药品；⑦其他不符合药品标准的药品。假药的界定：《药品管理法》第九十八条第一款、第二款规定，禁止生产（包括配制，下同）、销售、使用假药。有下列情形之一的，为假药：①药品所含成分与国家药品标准规定的成分不符（E错）；②以非药品冒充药品或者以他种药品冒充此种药品；③变质的药品（A错）；④药品所标明的适应症或者功能主治超出规定范围（C错）。